收集以下哪项的信息是问卷调查在口腔流行病学研究中的基本应用
A. 口腔保健知识
B. 口腔预防策略
C. 口腔健康相关生活质量
D. 口腔健康知识、态度和行为
E. 研究对象的属性

正确答案：D。口腔健康知识、态度和行为

解析：口腔健康知识、态度和行为是口腔流行病学中常用的资料，收集这些方面的信息是问卷调查在口腔流行病学研究中的基本应用。掌握“口腔健康问卷调查”知识点。